饮食中缺硒可能引起的地方病有
A. 克山病、克汀病
B. 大骨节病、黑脚病
C. 克山病、痛痛病
D. 黑脚病、水俣病
E. 克山病、大骨节病

正确答案：E。克山病、大骨节病

解析：本题考查饮食中缺硒可能引起的地方病。饮食中缺硒可能引起的地方病有克山病、大骨节病（E对ABCD错）。克山病是一种以心肌变性坏死为主要病理改变的生物地球化学性疾病，主要表现为心脏扩大、心力衰竭、心律失常。大骨节病是一种地方性、慢性骨关节变形性疾病，以四肢关节软骨和骺板软骨变性坏死、增生、修复为主要病理改变，以骨关节增粗、畸形、强直、肌肉萎缩、运动障碍为主要临床表现。